根据《突发公共卫生事件应急条例》，卫生行政部门应当对医疗机构责令改正、通报批评、给予警告处理的情形是
A. 未对突发事件开展流行病学调查
B. 未及时诊断不明原因的疾病
C. 未建立突发事件信息发布制度
D. 未履行突发事件报告职责
E. 未向社会发布突发事件信息

正确答案：D。未履行突发事件报告职责

解析：本题考查《突发公共卫生事件应急条例》。根据《突发公共卫生事件应急条例》，卫生行政部门应当对医疗机构责令改正、通报批评、给予警告处理的情形是未履行突发事件报告职责（D对）。医疗卫生机构有下列行为之一的，由卫生行政主管部门责令改正、通报批评、给予警告；情节严重的，吊销《医疗机构执业许可证》；对主要负责人、负有责任的主管人员和其他直接责任人员依法给予降级或者撤职的纪律处分；造成传染病传播、流行或者对社会公众健康造成其他严重危害后果，构成犯罪的，依法追究刑事责任：1.未依照本条例的规定履行报告职责，隐瞒、缓报或者谎报的；2.未依照本条例的规定及时采取控制措施的；3.未依照本条例的规定履行突发事件监测职责的；4.拒绝接诊病人的；5.拒不服从突发事件应急处理指挥部调度的。